患者脘腹痞闷，嘈杂，饥不欲食，恶心嗳气，口燥咽干，大便秘结，舌红少苔，脉细数。其治法是
A. 补气健脾，升清降浊
B. 养阴益胃，调中消痞
C. 清热化湿，和胃消痞
D. 疏肝解郁，和胃消痞
E. 健脾祛湿，理气除胀

正确答案：B。养阴益胃，调中消痞

解析：题中患者以脘腹痞闷为主症，故诊断为痞满。胃主降浊，胃阴不足，胃之浊阴不降，中焦气机失常不得宣通故脘腹痞闷，胃失和降；气机失常故恶心嗳气；胃阴津亏虚则胃纳失司，故嘈杂，饥不欲食；阴液亏乏，津不上承，故口燥咽干；阴液不足则肠道失于濡养，肠道干涩，故大便秘结；舌红少苔，脉细数为胃阴不足之象，故辨为胃阴不足证。补气健脾，升清降浊为痞满脾胃虚弱的治法（A错）。题中辨证为痞满胃阴不足证，治宜养阴益胃，调中消痞（B对）。清热化湿，和胃消痞为痞满湿热阻胃证的治法（C错）。疏肝解郁，和胃消痞为肝胃不和证的治法（D错）。健脾祛湿，理气除胀为痞满脾胃虚弱伴湿浊内蕴的治法（E错）。